大网膜的主要作用为
A. 保护空、回肠和横结肠
B. 限制腹膜腔内炎症的扩散
C. 限制空、回肠和横结肠的运动
D. 固定空、回肠和横结肠
E. 用作供体血管

正确答案：B。限制腹膜腔内炎症的扩散

解析：大网膜的主要作用是在腹膜腔有炎症时，包围病灶来限制炎症扩散(B对)。